治疗咳嗽风寒犯肺证，宜选用的中成药是
A. 通宣理肺丸
B. 二母宁嗽丸
C. 蛇胆川贝液
D. 固本止咳片
E. 小青龙合剂

正确答案：A。通宣理肺丸

解析：本题考查的是咳嗽的辨证论治。治疗咳嗽风寒犯肺证，宜选用的中成药是通宣理肺丸（A对）。通宣理肺丸为咳嗽风寒袭肺证的中成药应用。咳嗽风寒袭肺证：【中成药应用】常用中成药有通宣理肺丸、风寒咳嗽丸、杏苏止咳糖浆、三拗片。二母宁嗽丸（B错）为咳嗽风燥伤肺证的中成药应用。咳嗽风燥伤肺证：【中成药应用】常用中成药有蜜炼川贝枇杷膏、二母宁嗽丸、雪梨止咳糖浆。小青龙合剂（E错）为喘证风寒闭肺证的中成药应用。喘证风寒闭肺证：【中成药应用】常用中成药有小青龙胶囊、风寒咳嗽颗粒、苓桂咳喘宁胶囊、桂龙咳喘宁胶囊。中成药应用为蛇胆川贝散（C错）或固本止咳片（D错）的病证，2022年考试指南未明确说明。